临床常用的肾上腺皮质激素主要是
A. 盐皮质激素
B. 生长激素
C. 糖皮质激素
D. 抗生素
E. 性激素

正确答案：C。糖皮质激素

解析：临床常用的皮质激素主要是糖皮质激素。掌握“糖皮质激素”知识点。